有一年轻妇女，在分娩过程中突然呼吸困难，口唇及四肢末端发绀而亡。尸检肺血管内有角化上皮等物，此患者死因是下列哪一种：
A. 血栓栓塞
B. 气体栓塞
C. 脂肪栓塞
D. 羊水栓塞
E. 瘤细胞栓塞

正确答案：D。羊水栓塞

解析：该患者的死因是羊水栓塞（D对），年轻妇女，分娩过程中突发呼吸困难，发绀死亡，符合羊水栓塞的病因，尸检肺血管内有角化上皮等物（羊水栓塞的病理特征），羊水栓塞的证据是在显微镜下观察到肺小动脉和毛细血管内有羊水的成分，包括角化鳞状上皮、胎毛、胎脂、胎粪和黏液。血栓栓塞（A错）由血栓或血栓的一部分脱落引起的栓塞。气体栓塞（B错）是大量空气迅速进入血液循环或原溶于血液内的气体迅速游离，形成气泡而阻塞心血管。脂肪栓塞（C错）是循环血流中出现较大脂肪滴并阻塞小血管，脂肪栓塞的栓子常来源于长骨骨折、脂肪组织严重挫伤和烧伤，这些损伤可导致脂肪细胞破裂和释出脂滴，由破裂的骨髓血管窦状隙或静脉进入血液循环引起脂肪栓塞。瘤细胞栓塞（E错）是由肿瘤细胞侵蚀血管而引起的细胞栓塞。